外科治疗肝硬化门静脉高压症公认的重点
A. 治疗和预防出血
B. 控制腹水
C. 预防肝癌
D. 防止门静脉高压性胃病
E. 治疗脾功能亢进

正确答案：A。治疗和预防出血

解析：肝硬化门静脉高压症可导致食管胃底静脉曲张破裂大出血，这是门脉高压症最常见的并发症，难以止血，死亡率高。其外科治疗公认的重点是治疗和预防食管胃底静脉出血（A对）。腹水、肝癌、脾功能亢进均不是危及生命的急症，控制腹水（B错）、预防肝癌（C错）、治疗脾功能亢进（E错）均属于一般性治疗措施。门脉高压病人并发门静脉高压性胃病者仅占20%，防止门静脉高压性胃病（D错）不是外科治疗的重点。